流经沼泽或含腐殖质的地面水呈现
A. 棕色或棕黄色
B. 绿色或黄绿色
C. 黄褐色
D. 黑色
E. 蓝色

正确答案：A。棕色或棕黄色

解析：本题考查天然水的物理性状。天然水经常呈现的各种颜色是自然环境中有机物的分解或所含无机物造成的，最常见的是天然有机物分解产生的有机络合物的颜色。流经沼泽或含腐殖质的地面水呈现棕色或棕黄色（A对BCDE错）。